休克时交感-肾上腺髓质系统处于
A. 强烈兴奋
B. 强烈抑制
C. 先兴奋后抑制，最后衰竭
D. 先抑制后兴奋
E. 改变不明显

正确答案：A。强烈兴奋

解析：交感-肾上腺髓质系统在微循环缺血期、微循环淤血期和微循环衰竭期都处于强烈兴奋（A对BCDE错）。